以下有关普查优点描述正确的是
A. 工作量大，难免存在漏查
B. 不存在抽样误差
C. 适用于患病率低的疾病
D. 不适用于有简便易行诊断手段的疾病
E. 统一的调查技术可以有效保证调查质量

正确答案：B。不存在抽样误差

解析：本题考查普查的优点。普查的优点有：①调查对象为全体目标人群，不存在抽样误差（B对ACDE错）；②可以同时调查目标人群中多种疾病或健康状况的分布情况；③能发现目标人群中的全部病例，在实现“三早”（早期发现、早期诊断、早期治疗）预防的同时，全面地描述疾病的分布与特征，为病因分析研究提供线索。